有关流感病毒的叙述不正确的是
A. 在0～4℃可存活数周
B. 不耐热
C. 抗生素对流感病毒无效
D. 不耐酸
E. 对乙醚、乙醇、甲醛、丙酮、氯仿等都不敏感

正确答案：E。对乙醚、乙醇、甲醛、丙酮、氯仿等都不敏感

解析：本题考查流感病毒的抵抗力。流感病毒对热敏感（B对），通常56℃30分钟、100℃1分钟即可将其灭活；在0～4℃可存活数周（A对），在-70℃可存活数年，冷冻干燥后可长期保存。干燥、日光、紫外线及通风等都不利于它的存活，对乙醚、乙醇、甲醛、丙酮、氯仿等均敏感（E错，为本题正确答案）。不耐酸（D对），最适pH为7.0～8.0，在pH为5.0以下或9.0以上病毒感染力很快被破坏。抗生素对流感病毒无效（C对）。